初产妇，31岁。宫口已开全，阴道检查胎头矢状缝与骨盆横径一致，小囟门在9点，大囟门在3点
A. 顺时针转90度
B. 逆时针转90度
C. 逆时针转45度
D. 顺时针转45度
E. 逆时针30度

正确答案：A。顺时针转90度

解析：初产妇，宫口已开全，胎位还是枕横位，影响第二产程胎头下降，因为目前是ROT，所以目前应该采取的措施是顺时针转90度（A对），将胎头旋转为枕前位，从而保障胎儿顺利分娩。